确诊肿瘤最可靠的方法是
A. CT检查
B. DSA检查
C. B超检查
D. 肿瘤标记物检查
E. 病理学检查

正确答案：E。病理学检查

解析：病理形态学检查是目前确定肿瘤的直接而可靠的依据（E对）。与病理学检查相比，肿瘤标记物检查、B超检查、CT检查、DSA（数字减影血管造影技术）检查特异性敏感性均较低（ABCD错）。